幼儿认识父母面容的时间是
A. 4～5个月
B. 5～6个月
C. 6～7个月
D. 7～8个月
E. 8～9个月

正确答案：A。4～5个月

解析：幼儿4～5个月可认识母亲面容，初步分辨颜色，喜欢红色（A对）。5～6个月（B错）能注视远离的事物。6～7个月（C错）时目光可随上下移动的物体垂直方向转动。7～8个月（D错）正常持续发育。8～9个月（E错）开始出现视深度。